关于香豆素类抗凝血药，哪一项是错误的
A. 发挥作用慢，维持时间长
B. 维生素K能对抗其抗凝血作用
C. 体内外都有抗凝血作用
D. 口服就有抗凝血作用
E. 华法林的作用比双香豆素出现作用快，维持时间短

正确答案：C。体内外都有抗凝血作用

解析：香豆素类药物体外使用无效，在体内也需在原有的凝血因子Ⅱ、Ⅶ、Ⅸ、X、抗凝血蛋白C和S耗竭后才发挥抗凝作用。掌握“肝素、香豆素、阿司匹林和链激酶”知识点。